生产性噪声按其产生的来源来分，可分为
A. 机械性噪声、流体动力性噪声和电磁性噪声
B. 稳态噪声、非稳态噪声、脉冲噪声
C. 交通噪声、生活噪声、工业噪声
D. 低频噪声、中频噪声、高频噪声
E. 持续性噪声、脉冲噪声、电磁性噪声

正确答案：A。机械性噪声、流体动力性噪声和电磁性噪声

解析：本题考查生产性噪声的分类。噪声的分类方法有多种，按照来源，生产性噪声可以分为：1.机械性噪声。由于机械的撞击、摩擦、转动所产生的噪声，如冲压、切割、打磨机械等发出的声音。2.流体动力性噪声。气体压力或体积的突然变化或流体流动所产生的声音，如空气压缩或施放气笛）发出的声音。3.电磁性噪声。指由于电磁设备内部交变力相互作用而产生的声音，如变压器所发出的声音（A对BCDE错）。